反映甲状腺功能最敏感的实验室检查指标是
A. FT₃
B. FT₄
C. TSH
D. TRAb
E. TRH

正确答案：C。TSH

解析：甲状腺激素的生理性分泌有一个严密调控机制即下丘脑TRH-腺垂体TSH-甲状腺T₃、T₄轴，TRH、TSH可促进T₃、T₄分泌，T₃、T₄则可负反馈性抑制TSH、TRH分泌。甲亢时，往往在血清T₃、T₄尚未发生变化时，TSH水平已经下降，因此TSH（C对）是反映甲状腺功能最敏感的实验室检查指标。游离甲状腺激素FT₄（B错）、 FT₃（A错）在血清中含量甚微，它们与甲状腺激素的生物效应密切相关，是诊断临床甲亢的主要指标（P684），但不是反映甲状腺功能最敏感的实验室检查指标。TRAb（P684）（D错）即TSH受体抗体，包括刺激性（TSAb）和抑制性（TSBAb）两种抗体，检测到的TRAb仅能反映有针对TSH受体抗体存在，不能反映这种抗体的功能。TRH（E错）受TSH和T₃、T₄双重影响，不如TSH敏感。